心理治疗医生是否成熟称职的重要条件以及心理治疗成败的关键是
A. 医生的技术水平
B. 心理治疗实施的计划性
C. 是否坚持保密原则
D. 建立良好的医患关系
E. 治疗方法的灵活性

正确答案：D。建立良好的医患关系